下列何种情况下阻生齿可暂不拔除
A. 阻生齿有反复发生冠周炎病史
B. 阻生齿近中出现食物嵌塞
C. 完全骨埋伏阻生齿临床无症状
D. 正畸科要求拔除
E. 阻生齿大面积龋坏

正确答案：C。完全骨埋伏阻生齿临床无症状

解析：本题考查阻生牙拔除术的适应证与禁忌证。完全骨埋伏阻生齿临床无症状（C对）的阻生齿可暂不拔除。完全骨埋伏阻生齿临床无症状者可暂不拔除，继续观察，若以后引起临床症状再予以拔除。对有症状和病变或可能引起邻近组织产生症状和病变的阻生牙均应拔除：1.引起冠周炎的阻生牙。2.阻生牙龋坏或导致邻牙龋坏者。3.阻生牙引起食物嵌塞者。4.阻生牙压迫导致邻牙牙根吸收者。5.因阻生牙压迫导致邻牙牙周组织破坏者。6.阻生牙导致牙源性囊肿或肿瘤者。7.因正畸治疗需要拔除的阻生牙。8.可能为颞下颌关节紊乱病诱因的阻生牙。9.因完全骨阻生而被疑为原因不明的神经痛或病灶牙者。10. 正颌手术需要拔除者。11.预防下颌骨骨折。综上所述，阻生齿有反复发生冠周炎病史（A错）、阻生齿近中出现食物嵌塞（B错）、正畸要求拔除（D错）、阻生齿大面积龋坏者（E错）均是阻生齿拔除的适应症，阻生齿位置靠后操作空间不足，不方便治疗，其次未与对颌牙建立正常的咬合，即使治疗也无太大价值，拔除后也可避免给机体带来的其他问题，如颌骨骨髓炎、邻牙龋坏等。